轻型阿弗他溃疡临床表现错误的是
A. 溃疡中间凹陷，基底不硬
B. 周边围有约1mm的充血红晕带
C. 表面覆有浅黄色假膜
D. 灼痛感明显
E. 经治疗后才能愈合

正确答案：E。经治疗后才能愈合

解析：本题考查轻型阿弗他溃疡的临床表现。阿弗他溃疡具有不治自愈的自限性（E错，为本题的正确答案）。临床上阿弗他溃疡分为三种类型：轻型阿弗他溃疡、重型阿弗他溃疡、疱疹型阿弗他溃疡。轻型阿弗他溃疡临床表现为：溃疡表面覆盖浅黄色假膜（C对）、周边围有约1mm的充血红晕带（B对）、溃疡中间凹陷，基底不硬（A对）、灼痛感明显（D对）。